下列哪项不是慢性阻塞性肺疾病的养护措施
A. 预防感冒
B. 注意口腔卫生
C. 体虚应大补
D. 室内空气清新
E. 耐寒锻炼

正确答案：C。体虚应大补

解析：慢阻肺的病人脾胃功能比较弱，过食油腻荤腥也会虚不受补，可能会出现上火，甚至出现食积，反而给胃肠道造成一些负担（C错，为本题正确答案）。预防感冒是呼吸系统疾病的重要护理措施，慢阻肺的病人抵抗力差，天气变化时，极易受寒，易引起呼吸道感染，加重慢性阻塞性肺疾病的病情（A错）。慢阻肺病人如果不注意口腔卫生，会导致口腔内滋生大量的细菌，加重肺部的负担，导致慢阻肺病情加重。因此，慢阻肺的病人平时应注意口腔卫生（B错）。保持室内环境的空气清新，可以减少粉尘或者刺激性气体刺激（D错）。耐寒锻炼可以加强慢阻肺病人身体对外界气温变化的适应，增强身体的抗寒能力（E错）。